患儿，男，50天，体重5kg，时值夏季，体温37.9C，出现烦躁，哭闹不安，无其他症状。其家人到药店询购买退热药，药师应推荐
A. 减少衣被，可物理降温或必要时就诊
B. 阿苯片，半片，研碎后溶于少量温开水服用
C. 阿司匹林泡腾片（500mg）1/10片，溶于少量温开水服用
D. 对乙酰氨基酚片（500mg）1/10片，溶于少量温开水服用
E. 布洛芬口服液（0.1g/10ml）3ml，口服

正确答案：A。减少衣被，可物理降温或必要时就诊

解析：本题考查婴儿退烧药的选择。减少衣被，可物理降温或必要时就诊（A对）为2个月内婴儿退烧所选择的方法。世界卫生组织建议，两个月以内的婴儿禁用任何退热药（B错）。儿童体温达到39℃、经物理降温无效时，可适当用药，最好选用布洛芬的混悬液（E错）或含对乙酰氨基酚的滴剂（D错），不宜用阿司匹林（C错）。由题可知，该患儿50天，体温37.9C，应选物理退烧，禁用任何退烧药。